硬骨板矿物质被吸收多少时，才能在X线片上显示出来
A. 10%～30%
B. 30%～50%
C. 50%～60%
D. 60%～80%
E. 80%～90%

正确答案：B。30%～50%

解析：本题考查根尖周病概述。硬骨板矿物质被吸收30%～50%（B对）时，才能在X线片上显示骨吸收的临床表现。